牙酸蚀症中内源性酸蚀最常见的原因是
A. 胃酸
B. 氢氟酸
C. 硫酸
D. 草酸
E. 亚硝酸

正确答案：A。胃酸

解析：牙酸蚀症中内源性酸蚀：体内的酸进入口腔，最常见的原因是由于患有某些疾病使胃内容物进入口腔，胃酸长时间定期作用于牙齿硬组织发生酸蚀症。掌握“酸蚀症的预防”知识点。